除心包胸神志病外，手厥阴经腧穴还可用于治疗的病证是
A. 胃病
B. 肾病
C. 肝病
D. 胆病
E. 脾病

正确答案：A。胃病

解析：该题主要考察手厥阴心包经的主治概要，是记忆类题目。手厥阴心包经主治心胸、神志病，心痛，心悸，心烦，胸闷，癫狂痫等；胃腑病证，胃痛，呕吐等（A对）；经脉循行部位的其他病证，上臂内侧痛，肘、臂、腕挛痛，掌中热等。